下列哪项体征最能提示腹膜炎的存在
A. 肠鸣音减弱
B. 叩出移动性浊音
C. 腹部压痛
D. 腹部触及肿块
E. 反跳痛

正确答案：E。反跳痛

解析：典型的腹膜炎三联征为腹肌紧张、压痛和反跳痛，当出现反跳痛时，表明炎症已累及腹膜壁层，故反跳痛最能提示腹膜炎的存在（E对）。肠鸣音减弱可见于腹膜炎、电解质紊乱及胃肠动力低下等（A错）。叩出移动性浊音提示腹腔内游离腹水在1000ml以上（B错）。腹部压痛可见于腹腔内炎症、淤血、肿瘤等（C错）。腹部触及肿块见于炎症性肿块、囊肿、肿大淋巴结以及良、恶性肿瘤等（D错）。